成人脊髓的终丝
A. 全长被硬脊膜包裹
B. 附着于骶骨的背面
C. 内有神经细胞
D. 在第2骶椎处被硬脊膜包裹，向下止于尾骨背面
E. 在第2腰椎处出硬脊膜，止于第2骶骨背面下缘

正确答案：D。在第2骶椎处被硬脊膜包裹，向下止于尾骨背面

解析：终丝即软脊膜在脊髓末端移行后形成的一根无神经组织的膜性结构，约在第二骶骨水平以下硬脊膜包裹而终止于尾骨的背面（D对）。